下列急性菌痢患者的表现不典型的是
A. 里急后重
B. 发热
C. 呕吐
D. 腹痛
E. 黏液便

正确答案：C。呕吐

解析：急性轻型（非典型）：多无全身中毒症状，体温正常或者稍高，腹痛不明显，腹泻每日3～5次，大便为黄色糊状或水样，带有少量粘液，里急后重也不明显，可有呕吐（C对）。病程约3～6天。易误诊为肠炎或结肠炎，若治疗不及时或不彻底易转变为慢性。急性普通型（典型）起病急，畏寒、发热（B错），可伴乏力、头痛、纳差等毒血症症状，腹泻、腹痛（D错）、里急后重（A错），脓血便或黏液便（E错）、左下腹部压痛。